患者，男，38岁。左颧面部疔疮，根深坚硬，形如钉丁状，红肿灼痛，伴发热、恶寒、头痛等全身症状，舌红苔腻，脉滑数。其治法是
A. 清热消肿
B. 和营消肿
C. 清热凉血
D. 清热解毒
E. 和营托毒

正确答案：D。清热解毒

解析：颜面部疔疮是指发生于颜面部的急性化脓性疾病，本患者左颧面部疔疮，热毒蕴结于面部故见根深坚硬，形如钉丁状，红肿灼痛，伴发热、恶寒、头痛，热客血脉故见舌红，脉滑数。故辨证为热毒蕴结证，治宜清热解毒（D对）。清热消肿：清热解毒，和营消肿为疫疔之疫毒蕴结证的治法（AB错）。清热凉血、解毒为颜面部疔疮之火毒炽盛证的治法（C错）。清热化痰，和营托毒为锁喉痈之热盛肉腐证的治法（E错）。